女，60岁。绝经5年，反复阴道流血3次，量中等。平时白带少许。B超示子宫稍大，宫腔内可见实质不均回声区，形态不规则，宫腔线消失。首先考虑的诊断是
A. 输卵管癌
B. 子宫内膜癌
C. 子宫颈癌
D. 子宫内膜炎
E. 老年性阴道炎

正确答案：B。子宫内膜癌

解析：患者为老年妇女，出现绝经后阴道流血（子宫内膜癌的主要表现为绝经后阴道流血），B超示子宫稍大，宫腔内可见实质不均回声区，形态不规则，宫腔线消失（典型子宫内膜癌的超声图像有宫腔有实质不均匀回声区，或宫腔线消失，肌层内有不均匀回声区），首先应考虑子宫内膜癌（B对）。输卵管癌（P332）（A错）典型临床表现为阴道排液、腹痛及盆腔肿块“三联征”。子宫颈癌（P306）（C错）常表现为接触性出血，即性生活或妇科检查后阴道流血。子宫内膜炎（P261）（D错）常表现为阴道大量脓性分泌物，且有臭味。老年性阴道炎（P252、P316）（E错）主要表现为阴道分泌物增多及外阴瘙痒、灼热感，B超检查宫腔内无异常发现。